可用与二氯靛酚钠试液反应鉴别的药物是
A. 地西泮
B. 黄体酮
C. 维生素B₁
D. 维生素C
E. 盐酸麻黄碱

正确答案：D。维生素C

解析：本题考查维生素C的鉴别反应。2,6-二氯靛酚为一种染料，其氧化型在酸性介质中为玫瑰红色，在碱性介质中为蓝色。与维生素C（D对）作用后生成还原型的无色酚亚胺，从而使颜色消失。